八正合剂能清热、利尿、通淋，其处方的药物组成有川木通、车前子、萹蓄、滑石、灯芯草、栀子、大黄、甘草，方中大黄应选用的饮片是
A. 醋大黄
B. 生大黄
C. 酒大黄
D. 大黄炭
E. 熟大黄

正确答案：B。生大黄

解析：本题考查的是大黄的炮制作用。八正合剂中大黄应选用的饮片是生大黄（B对）。八正合剂能清热、利尿、通淋，应选用生大黄，取其攻积导滞、泻火解毒作用。大黄：【炮制作用】大黄味苦，性寒。归脾、胃、大肠、肝、心经。①生大黄苦寒沉降，气味重浊，走而不守，直达下焦，泻下作用峻烈，具有攻积导滞、泻火解毒的功能。用于实热便秘，高热，谵语，发狂，吐血，衄血，湿热黄疸，跌打瘀肿，血瘀经闭，产后瘀阻腹痛，痈肿疔毒；外治烧烫伤。②酒炙大黄（C错）其苦寒泻下作用稍缓，并借酒升提之性，引药上行，善清上焦血分热毒。用于目赤咽肿，齿龈肿痛。③熟大黄（E错）经酒蒸后，泻下作用缓和，减轻腹痛之副作用，并增强活血祛瘀之功。④大黄炭（D错）泻下作用极微，有凉血化瘀止血作用。用于血热有瘀之出血。⑤醋大黄（A错）泻下作用减弱，以消积化瘀为主，用于食积痞满，产后瘀停，癥瘕癖积。⑥清宁片泻下作用缓和，具缓泻而不伤气，逐瘀而不败正之功。用于饮食停滞，口燥舌干，大便秘结之年老、体弱者及久病患者，可单用。